甲状腺功能亢进发生心力衰竭是由于
A. 容量负荷过重
B. 压力负荷过重
C. 两者均有
D. 两者均无
E. 无

正确答案：A。容量负荷过重

解析：甲状腺功能亢进时，外周血管阻力降低，静脉回心血量增加，左右心室舒张期充盈压升高，即容量负荷过重（A对），长期负荷过重超过心肌代偿能力时可导致心衰。